小腿后群肌
A. 分为浅、中、深层
B. 浅层有腓肠肌和比目鱼肌
C. 中层有腓骨长、短肌
D. 深层有胫骨后肌和趾长伸肌
E. 伸踝关节

正确答案：B。浅层有腓肠肌和比目鱼肌

解析：小腿后群肌分为浅层和深层，而非浅、中、深层（A错）；浅层有腓肠肌和比目鱼肌（B对）；腓骨长、短肌是小腿外侧群肌，而非小腿后群肌中层（C错）；胫骨后肌是小腿后群肌，但趾长伸肌是小腿前群肌（D错）；无伸踝关节（E错）的功能。